一位诊断为慢性牙周炎的牙周病患者，已于2个月前完成牙周基础治疗，现需选择最佳手术方法：袋深5～6mm，X线片：牙槽骨吸收不规则，应选择
A. 根向复位瓣术
B. 骨成形术
C. 牙龈切除术
D. 牙周翻瓣术+骨成形术
E. 引导性组织再生术

正确答案：D。牙周翻瓣术+骨成形术

解析：本题考查牙周病的手术治疗。牙周基础治疗后2个月，若袋深仍在5～6mm，X线显示牙槽骨吸收不规则时，应选择牙周翻瓣术+骨成形术（D对），即用手术方法切除部分牙周袋及袋内壁，并翻起牙龈的黏膜骨膜瓣，在直视下刮净龈下牙石和肉芽组织，修整牙槽骨的边缘部分，使之恢复或接近其生理外形，然后将牙龈瓣复位、缝合，术后可达到使牙周袋变浅和恢复牙槽骨生理外形的目的。冠向复位瓣术（A错）适用于不伴有深牙周袋和牙槽骨缺损的牙龈退缩的治疗，当袋深5～6mm，X线片显示牙槽骨吸收不规则时不宜选用。改良Windman术（B错）仅切除病变的袋内壁组织，保留并翻起外侧健康的组织瓣，彻底刮净感染的肉芽组织、根面牙石，再将软组织瓣原位复位，当牙槽骨吸收不规则时不宜选用。植骨术（C错）是采用骨或骨的替代品等移植材料来修复因牙周炎造成的牙槽骨缺损的方法，适用于二壁及三壁骨下袋或Ⅱ度根分叉病变，当袋深5～6mm，X线片显示牙槽骨吸收不规则时不宜选用。引导性组织再生术（E错）适用于窄而深的二壁或三壁骨下袋，Ⅱ度根分叉病变以及局限性牙龈退缩，当袋深5～6mm，X线片显示牙槽骨吸收不规则时不作为最佳手术方法。